真菌性脑膜炎时脑脊液氯化物浓度应低于（mmol/L）
A. 160
B. 150
C. 140
D. 130
E. 120

正确答案：E。120

解析：脑脊液氯化物浓度正常值为120～130mmol/L。脑脊液氯化物增高见于慢性肾功能不全、肾炎、尿毒症、呼吸性碱中毒。脑脊液氯化物减低见于结核性脑膜炎、化脓性脑膜炎、真菌性脑膜炎、风湿性脑病等（E对）。